可出现上腹部明显胃蠕动波的是
A. 急性胃炎
B. 慢性胃炎
C. 贲门癌
D. 胰头癌
E. 幽门梗阻

正确答案：E。幽门梗阻

解析：幽门梗阻（E对）时，梗阻近端的胃饱满而隆起，可显出胃的轮廓，称为胃。当胃蠕动加强，则可出现上腹部明显胃蠕动波（E对）。急性胃炎（A错）、慢性胃炎（B错）、贲门癌（C错）、胰头癌（D错）均不会出现胃蠕动波。